流行性乙型脑炎极期的临床表现不包括
A. 呼吸衰竭
B. 惊厥或抽搐
C. 持续高热
D. 意识障碍
E. 肾衰竭

正确答案：E。肾衰竭

解析：流行性乙型脑炎极期的临床表现有：持续高热（C对）；由于神经细胞广泛受累和脑实质的炎性损害，出现嗜睡、昏迷（D对）；由于脑神经核团受损，出现抽搐、痉挛（B对）等上运动神经元损害的表现；由于脑桥和延髓的运动神经细胞受损，出现吞咽困难，甚至发生呼吸衰竭（A对）。流行性乙型脑炎极期一般不出现肾衰竭（E错，为本题正确答案）。